牙体缺损修复预备过程中修复体覆盖牙齿点隙窝沟裂的主要目的是
A. 去除龋坏牙体组织
B. 提供良好的固位形和抗力形
C. 为防止继发龋
D. 增进修复体的美学效果
E. 促进牙周组织的健康

正确答案：C。为防止继发龋

解析：本题考查牙体缺损修复治疗原则。为了防止继发龋（C对），修复体应覆盖牙齿点隙窝沟裂等部位，并将修复体的边缘扩展至自洁区。